二型观测线倒凹大的一侧是
A. 远缺隙侧
B. 近缺隙侧
C. 颊侧
D. 舌侧
E. 近远缺隙侧都有

正确答案：B。近缺隙侧

解析：二型观测线：为基牙向缺隙方向倾斜时所画出的观测线。此线在近缺隙侧距（牙合）面近，而远缺隙侧距（牙合）面远，说明近缺隙侧的倒凹大，远缺隙侧的倒凹小。掌握“局部义齿类型，肯氏分类及模型观测”知识点。